治疗风寒感冒，除主穴外，还应选取的配穴是
A. 曲池，尺泽
B. 风门，肺俞
C. 阴陵泉，委中
D. 足三里，脾俞
E. 少商，商阳

正确答案：B。风门，肺俞

解析：感冒的主症为恶寒发热，头痛，鼻塞流涕，脉浮。为外邪侵犯肺卫所致，治以法风解表。以手太阴、手阳明经及督脉穴为主。以列缺、合谷、大椎、风池、太阳为主穴，风寒感冒配风门、肺俞（B对）。